牙槽窝的游离缘
A. 牙槽骨
B. 牙槽窝
C. 牙槽嵴
D. 牙槽间隔
E. 牙根间隔

正确答案：C。牙槽嵴

解析：牙槽嵴：牙槽窝的游离缘。掌握“上颌骨解剖特点”知识点。